上颌义齿基托腭侧基托光滑，未做腭皱
A. 哨音
B. 恶心
C. 咬颊
D. 咬唇
E. 弹响

正确答案：A。哨音

解析：上颌义齿的牙弓在前磨牙位置狭窄，上前牙舌面及腭侧基托表面过于光滑，由于气道狭窄，说话时气流快速通过会产生哨音。掌握“全口义齿戴入后问题及处理”知识点。